肿瘤免疫学诊断，最可靠的方法是
A. AFP的检测
B. 癌胚抗原的检测
C. 检查诱发肿瘤Ag的抗体
D. 检查细胞免疫功能
E. 利用肿瘤McAb进行血清学检查

正确答案：E。利用肿瘤McAb进行血清学检查